女性，35岁。2个月来每于饭前上腹痛，进食后缓解，反酸，钡餐：十二指肠部变形，局部压痛，首先考虑
A. 胃溃疡
B. 十二指肠溃疡
C. 癌
D. 复合型溃疡
E. 巨大溃疡

正确答案：B。十二指肠溃疡

解析：中年女性患者，有反酸，餐前上腹痛，进食缓解（节律性上腹饥饿痛）病史2个月。钡餐显示十二指肠球部变形（十二指肠溃疡表现为球部激惹及球部畸形），诊断考虑为十二指肠溃疡（B对）。胃溃疡（A错）主要表现为餐后痛，1～2小时后缓解。胃癌（C错）可有上腹痛、餐后加重、纳差、厌食、乏力及体重减轻，无与进餐相关的节律性上腹痛。复合性溃疡（D错）指胃和十二指肠均有活动性溃疡，多见于男性，典型者有轻度或中度剑突下持续疼痛。巨大溃疡（E错）指直径大于2cm的溃疡，常见于有NSAIDs服用史及老年患者，疼痛剧烈而顽固，多放射至背部，易发生慢性穿透或穿孔。